广义关联强度包括
A. 分类相关、积差相关和分布一致性
B. 分类相关、剂量-反应关系和等级相关
C. 等级相关、剂量-反应关系和生态学相关
D. 分类相关、等级相关和分布一致性
E. 分类相关、剂量-反应关系和生态学相关

正确答案：E。分类相关、剂量-反应关系和生态学相关

解析：本题考查广义关联强度。广义关联强度包括分类相关、剂量-反应关系和生态学相关（E对ABCD错），狭义关联强度是用来评价病因和疾病之间关联度高低的指标，一般用相对危险指标衡量。